4个月的婴儿，腹泻3天。水样便，眼窝凹陷，皮肤弹性略差，适宜的治疗应为
A. 禁食
B. 停止母乳喂养
C. 无论何种病原，大量使用抗生素
D. 及时补液，控制脱水
E. 给予升压药，防止血压过低

正确答案：D。及时补液，控制脱水